人体实验的类型包括
A. 天然实验、自愿实验、强迫实验、欺骗实验
B. 天然实验、强迫实验、动物实验、志愿实验
C. 药物实验、志愿实验、自然实验、强迫实验
D. 自然实验、自我实验、强迫实验、临床实验
E. 随机实验、天然实验、自我实验、强迫实验

正确答案：A。天然实验、自愿实验、强迫实验、欺骗实验

解析：根据人体试验发生原因的不同分类，可分为天然试验和人为试验；根据人体试验中受试对象及其参与意愿的不同分类，可分为自体试验、自愿实验、欺骗试验和强迫试验（A对）。由于自然灾害和战争可形成大面积的研究样本群称为天然试验。自愿实验是实验者出于医学的目的，受试者本人在一定的社会目的、健康目的或经济利益的支配下自愿参加的人体实验，包括自我实验和志愿实验。强迫实验通常是在一定的军事、政治或行政组织强大压力下，强迫受试者进行人体实验。欺骗实验是对一些风险较大的人体实验，实验者对受试者告知的实验信息不准确，或者采取蒙骗手法的。